身体状态主要包括
A. 认知功能、情绪反应
B. 情绪反应、家庭适应性、活动受限
C. 活动受限、角色功能受限、体力适度性
D. 活动适度性、情绪反应
E. 社会资源、社会接触

正确答案：C。活动受限、角色功能受限、体力适度性

解析：本题考查身体状态的内容。身体状态主要包括：1.活动受限：①躯体活动受限：屈体、弯腰等；②迁移受限：卧床、不能移动等；③自我照顾能力下降：生活不能自理。2.角色功能受限：①角色功能种类受限；②角色功能数量受限；③角色紧张：个体所承担的各种角色同时向个体提出各种要求，或者是个体所承担的某一角色内部所规定的各种行为规范之间不相容，从而使个体感受到时间或精力分配上或情感上的矛盾状况；④角色冲突：当个体的角色行为与角色认知或角色期待产生不协调状态时的内心体验。3.体力适度性（C对ABDE错）：①疲劳感；②无力；③虚弱感。